对医术与医德之间关系错误的理解是
A. “医乃仁术”
B. 有能力做的就应该去做
C. “大医精诚”
D. 临床医学决策同时也是伦理决策
E. 前沿医学技术应用于临床必须有医德参与

正确答案：B。有能力做的就应该去做